女，30岁，开口受限1年，既往有关节弹响史。临床检查见开口度1指半，开口型左偏。首先应进行许勒位及升支侧位检查。关节结构为T形致密团块代替，不是颞下颌关节紊乱综合征的表现。平片及体层摄影检查发现颞下颌关节前间隙增宽，髁状突骨质未见异常，应进一步进行颞下颌关节造影检查。左侧颞下颌关节造影侧位体层闭口位，关节盘后带位于髁突横嵴前方，开口位见髁突前方的关节盘变形，似一肿块压迫造影剂的影像，应诊断为不可复性盘前移位。颞下颌关节上腔造影侧位体层闭口位片的正常影像应当是
A. 关节盘后带恰位于髁突横嵴之上
B. 关节盘中带恰对髁突横嵴
C. 关节盘前带恰位于髁突横嵴
D. 关节盘后带恰位于髁突横嵴前方
E. 关节盘后带恰位于髁突横嵴后方

正确答案：A。关节盘后带恰位于髁突横嵴之上

解析：本题考查颞下颌关节上腔造影侧位体层闭口位片的正常影像。颞下颌关节上腔造影侧位体层闭口位片为颞下颌关节紊乱病临床上最多应用的摄影位置。可见关节盘本体部位于关节结节后斜面和髁突前斜面之间，关节盘后带恰位于髁突横嵴之下（A对DE错）。关节盘中带（B错）在关节盘本体部的中央凹陷内，凹陷前后上突部分分别为关节盘前带（C错）和后带。